肝脏面肝门左纵沟的前部有
A. 肝圆韧带
B. 静脉韧带
C. 镰状韧带
D. 下腔静脉
E. 胆囊

正确答案：A。肝圆韧带

解析：肝脏面肝门左纵沟前部有肝圆韧带裂，容纳肝圆韧带(A对)。静脉韧带(B错)位于沟后部的静脉韧带裂，镰状韧带(C错)位于肝膈面，下腔静脉(D错)位于右纵沟后部，胆囊(E错)位于右纵沟前部。